对洛美沙星进行人体生物利用度研究，采用静脉注射与口服给药方式，给药剂量均为400mg·h/ml和36㎍·h/ml。基于上述信息分析，该药生物利用度计算正确的是
A. 相对生物利用度为55%
B. 绝对生物利用度为55%
C. 相对生物利用度为90%
D. 绝对生物利用度为90%
E. 绝对生物利用度为50%

正确答案：D。绝对生物利用度为90%

解析：本题考查绝对生物利用度。绝对生物利用度：F=AUCT/AUCiv×100%=36㎍·h/ml/40㎍·h/ml×100%=90%（D对BE错）。相对生物利用度：F=AUCT/ACUR×100%，因为参比制剂的AUC未知，故无法计算相对生物利用度（AC错）。